纳少，厌食油腻，黄疸胁痛，身热不扬，证属
A. 肝火炽盛
B. 肝胃不和
C. 肝胆湿热
D. 肝脾不调
E. 湿热蕴脾

正确答案：C。肝胆湿热

解析：肝主疏泄，调节胆汁分泌。湿热内蕴，肝胆疏泄失职，气机不畅，故胁痛；湿热阻滞，脾胃纳运失司，则纳少，厌食油腻；湿热郁蒸，胆汁不循常道，泛溢肌肤，则身目发黄，出现黄疸；湿邪阻遏而致热不能宣散透发，则身热不扬；故辨证为肝胆湿热证（C对）。肝火炽盛是以头痛、胁痛、烦躁、耳鸣及实热症状为主要表现的证（A错）。肝胃不和是以胸胁胀痛、嗳气、吞酸、情绪抑郁及气滞症状为主要表现的证（B错）。肝脾不调是以胸胁胀痛、腹胀、便溏、情志抑郁症状为主要表现的证（D错）。湿热蕴脾是以腹胀、纳呆、便溏及湿热症状为主要表现的证（E错）。